减少蔬菜水果中维生素C损失的方法
A. 先洗后切，急火快炒
B. 先切后洗，急火快炒
C. 长时间浸泡
D. 长时间加热
E. 熬煮时多放水

正确答案：A。先洗后切，急火快炒